腹股沟深环位于
A. 腹股沟中点上方1cm
B. 腹股沟中点上方2cm
C. 腹股沟中点
D. 腹股沟中点下方1cm
E. 腹股沟中点下方2cm

正确答案：B。腹股沟中点上方2cm

解析：腹股沟管位于腹前外侧壁的下部、腹股沟韧带内侧半的上方，由外上斜向内下，男性的精索或女性的子宫圆韧带由此通过。腹股沟管有内、外两口，其中内口即腹股沟管深（腹）环，位于腹股沟中点上方2cm处（B对）。